伤寒最具特征性的病变部位在
A. 干酪样坏死
B. 脂肪变
C. 内基小体
D. 伤寒结节
E. 网状软化灶

正确答案：D。伤寒结节

解析：伤寒（typhoid fever）是由伤寒杆菌引起的经消化道传播的急性传染病。临床特征为长程发热、全身中毒症状、相对缓脉、肝脾肿大、玫瑰疹及白细胞减少等。主要并发症为肠出血、肠穿孔。初期相当于病程第1周。病多缓起，体温呈阶梯状上升，于5～7日达39.5℃或以上。伤寒杆菌侵入回肠集合淋巴结的单核吞噬细胞内繁殖形成初发病灶，后引起二次菌血症进一步感染（D对）。